具有祛风湿，补肾安胎功效的药物是
A. 独活
B. 川乌
C. 防己
D. 桑寄生
E. 络石藤

正确答案：D。桑寄生

解析：桑寄生苦燥甘补，既能祛风湿，又长于补肝肾、强筋骨，对痹证日久，损及肝肾，腰膝酸软，筋骨无力者尤宜，且本品能补肝肾，养血，而固冲任，安胎元（D对）；独活（A错）、川乌（B错）、防己（C错）、络石藤（E错）虽有祛风湿的功效，但没有安胎元的功效。